患者久病尿血，体倦乏力，气短声低，面色不华，舌质淡，脉弱。治疗应首选：
A. 知柏地黄丸
B. 无比山药九
C. 小蓟饮子
D. 归脾汤
E. 十灰散

正确答案：D。归脾汤

解析：患者久病尿血，且无涩痛，可诊断为血证—尿血。体倦乏力，气短声低，面色不华，可辨证为脾不统血；舌质淡，脉弱为虚证的征象；代表方为归脾汤（D对）。知柏地黄丸为肾虚火旺证的代表方（A错）。无比山药丸为肾气不固证的代表方（B错）。小蓟饮子为下焦湿热证的代表方（C错）。十灰散为紫斑血热妄行证的代表方（E错）。